国家发布并实施的尘肺X线诊断标准分期标准为
A. 3期
B. 4期
C. 8期
D. 6期
E. 12期

正确答案：A。3期

解析：本题考查尘肺的分期。根据2015年我国最新修订的《职业性尘肺病的诊断》，将尘肺分为三期（A对BCDE错），并规定了当出现相对应的症状时，则代表患者进入了疾病的不同分期。